直接汇入颈内静脉的结构是
A. 直窦
B. 横窦
C. 下矢状窦
D. 岩下窦
E. 无

正确答案：D。岩下窦

解析：直接汇入颈内静脉的结构是岩下窦（D对），横窦（B错）汇入乙状窦，下矢状窦（C错）汇入直窦，直窦（A错）汇入窦汇。